下述控制梭状芽孢杆菌生长繁殖的方法中，错误的是
A. 用氧化剂冲洗创口
B. 用止血带防止感染扩散
C. 用3个大气压的纯氧治疗
D. 投给大剂量的青霉素
E. 可使用四环素

正确答案：B。用止血带防止感染扩散

解析：梭状芽孢杆菌是气性坏疽的致病菌，属专性厌氧菌。故为控制其生长繁殖，应破坏其缺氧的生长环境。用止血带（B错，为本题正确答案）会加重组织的缺血、缺氧与失活，更有利于细菌繁殖生长。常见产气荚膜梭菌对青霉素大多敏感，但剂量需大。投给大剂量的青霉素（D对）能有效抑制梭状芽孢杆菌生长繁殖，切除坏死和已无活性的组织后使用氧化剂冲洗创口（A对），也可用3个大气压的纯氧治疗（C对）造成不适合细菌生长繁殖的环境，提高治疗效果。必要时需再次清创。四环素（E对）作为广谱抗生素曾长期作为临床抗感染治疗的主要抗生素，但由于其突出的不良反应目前已很少用。